18883-2002）》规定要求，新风量
A. ≥10m³/h·每人
B. ≥20m³/h·每人
C. ≥25m³/h·每人
D. ≥30m³/h·每人
E. ≥40m³/h·每人

正确答案：D。≥30m³/h·每人

解析：本题考查我国《室内空气质量标准（GB/T 18883-2002）》规定要求的新风量。我国《室内空气质量标准（GB/T 18883-2002）》规定，新风量≥30m³/（h·人）（D对ABCE错）。